左心衰竭时最早出现和最重要的症状是
A. 呼吸困难
B. 咳嗽
C. 咯血
D. 下垂性凹陷性水肿
E. 发绀

正确答案：A。呼吸困难

解析：左心衰竭时最早出现和最重要的症状是呼吸困难（A对），咳嗽（B错）、咯血（C错）、发绀（E错）也为左心衰竭的症状，但不是最早出现的症状。下垂性凹陷性水肿为右心衰竭的典型症状（D错）。